促胃肠运动药有
A. 米索前列醇
B. 溴己胺
C. 甲氧氯普胺
D. 多潘立酮
E. 奥美拉唑

正确答案：C、D。甲氧氯普胺；多潘立酮

解析：本题考查促胃肠运动药。甲氧氯普胺（C对）、多潘立酮（D对）为促胃肠运动药；米索前列醇（A错）可抑制胃酸分泌，同时也有黏膜保护作用；溴己胺（B错）为祛痰药；奥美拉唑（E错）为胃壁细胞H⁺泵抑制药，可抑制各种原因引起的胃酸分泌。